治风热咳嗽宜用的是
A. 二陈丸
B. 急支糖浆
C. 镇咳宁糖浆
D. 清肺抑火丸
E. 蜜炼川贝批把膏

正确答案：B。急支糖浆

解析：本题考查的是急支糖浆的主治。治风热咳嗽宜用的是急支糖浆（B对）。急支糖浆：【主治】外感风热所致的咳嗽，症见发热、恶寒、胸膈满闷、咳嗽咽痛；急性支气管炎、慢性支气管炎急性发作见上述证候者。二陈丸（A错）：【主治】痰湿停滞导致的咳嗽痰多、胸脘胀闷、恶心呕吐。清肺抑火丸（D错）：【主治】痰热阻肺所致的咳嗽、痰黄黏稠、口干咽痛、大便干燥。蜜炼川贝枇杷膏（E错）：【主治】肺燥咳嗽，痰黄而黏，胸闷，咽喉疼痛或痒，声音嘶哑。镇咳宁糖浆（C错），2022年考试指南未明确说明。